突发公共卫生事件分类
A. 重大传染病疫情
B. 群体性不明原因疾病
C. 重大食物中毒和职业中毒
D. 其他严重影响公众健康的事件
E. 以上答案均正确

正确答案：E。以上答案均正确

解析：突发公共卫生事件分类：①重大传染病疫情；②群体性不明原因疾病：③重大食物中毒和职业中毒；④其他严重影响公众健康的事件。掌握“突发公共卫生事件”知识点。